取粉末置白纸上，用火烘烤则熔化，对光照视呈鲜艳的血红色的药材是
A. 没药
B. 血竭
C. 安息香
D. 阿魏
E. 枫香脂

正确答案：B。血竭

解析：本题考查的是血竭的性状鉴别。取粉末置白纸上，用火烘烤则熔化，对光照视呈鲜艳的血红色的药材是血竭（B对）。血竭【性状鉴别】本品粉末，置白纸上，用火隔纸烘烤即熔化，但无扩散的油迹，对光照视呈鲜艳的红色。以火燃烧则产生呛鼻的烟气。没药（A错）【性状鉴别】本品粉末乙醚滤液置蒸发皿中挥尽后，残留的黄色液体滴加硝酸，显褐紫色。本品粉末加香草醛试液数滴，天然没药立即显红色，继而变为红紫色；胶质没药立即显紫红色，继而变为蓝紫色。安息香（C错）【性状鉴别】加热后则软化熔融。气芳香，味微辛。嚼之带沙粒感。阿魏（D错）【性状鉴别】具强烈持久的蒜样特异臭气，味辛辣如蒜，嚼之有烧灼感。本品纯净而无杂质。加水研磨则成白色乳状液。枫香脂（E错）【性状鉴别】取本品少量，用微火灼烧，有多烟火焰，具特异香气。